进入疟区时，作为病因性预防的常规用药是
A. 伯氨喹
B. 氯喹
C. 乙胺嘧啶
D. 磺胺
E. 奎宁

正确答案：C。乙胺嘧啶

解析：伯氨喹（A错）能杀灭肝脏中休眠子，控制疟疾的复发，并能杀灭各种疟原虫的配子体，控制疟疾传播。氯喹、奎宁均能杀灭红细胞内期裂殖体，主要用于控制症状发作和预防性抑制疟疾症状发作（BE错）。乙胺嘧啶（C对）能杀灭红细胞外期的子孢子，发挥病因性预防作用。磺胺类和砜类（D错）也能杀灭红细胞外期的子孢子发挥病因性预防，但主要用于耐氯喹的恶性疟。